对上市5年以内的药品须报告其引起的
A. A类药品不良反应
B. B类药品不良反应
C. 新的药品不良反应
D. 所有可疑不良反应
E. 药物相互作用引起的不良反应

正确答案：D。所有可疑不良反应